患者，女，35岁，反复右上腹阵发性绞痛、痛连右肩背1个月，B超胆囊大小正常，胆汁回声正常，胆总管轻度扩张，下端见直径0.6cm结石一枚，胰腺未见异常。首次治疗可首选
A. 排石疗法
B. 溶石疗法
C. 碎石疗法
D. 取石疗法
E. 外科手术

正确答案：D。取石疗法

解析：患者反复右上腹阵发性绞痛连右肩背，胆总管轻度扩张，见0.6cm结石，诊断为胆结石，首次治疗可选取石疗法（D对E错）。排石疗法主要用于部分胆结石病人的排石治疗，尤其对一些肝外胆管结石（A错）。溶石疗法适应症：①症状轻微的胆固醇结石患者，对胆红素结石患者无效。②患者胆囊造影显影要良好，胆囊不显影者无效。③胆囊结石直径在1～2cm之内，而且应是透光性结石。阻光性的钙化结石，胆管内结石，直径2～3cm的结石以及巨大结石，服用胆石溶解剂无效（B错）。碎石疗法是除无法纠正的出血性疾病及结石远端的腔道梗阻为体外碎石的绝对禁忌症外，其它情况均可在控制范围内进后体外冲击波碎石（C错）。